既能治疗肝气郁滞，胁肋疼痛，疝气疼痛，又可用治食积不化的药物是
A. 橘皮
B. 木香
C. 枳实
D. 青皮
E. 乌药

正确答案：D。青皮

解析：青皮苦泄辛行温通，性猛入肝，善于疏理肝胆之气，尤宜于肝郁气滞，胁肋疼痛，疝气疼痛；本品辛行，具有消食之效（D对）。橘皮（A错）应用于脘腹胀满，食少吐泻，呕吐，呃逆，胸痹。木香（B错）应用于脾胃气滞，脘腹胀满，食积不消，泻痢后重，胸胁胀痛。枳实（C错）应用于积滞内停，痞满胀痛，泻痢后重，大便不通，痰阻气滞，胸痹，结胸。乌药（E错）应用于寒凝气滞，胸腹胀痛，气逆喘急，疝气疼痛，经寒腹痛，遗尿尿频。